消渴的病机主要是
A. 气阴两虚
B. 阴虚燥热
C. 阴阳两虚
D. 血脉瘀滞
E. 燥热内结

正确答案：B。阴虚燥热

解析：消渴病是由于阴亏燥热，五脏虚弱所致的以多饮、多食、多尿、形体消瘦为特征的病证。气阴两虚是消渴病情迁延，阴伤及气所致（A错）。消渴病位在肺、胃、肾，其病机以阴虚为本，燥热为标（B对）。消渴日久不愈，阴损及阳，则出现阴阳两虚，但非主要病机（C错）。消渴阴虚内热，损津耗液，血脉为之虚涩而成血瘀。消渴气阴两虚或阴阳两虚，血液生化乏源，运行无力而成瘀血，故消渴常与瘀血有关，但非主要病机（D错）。消渴燥热内结可致营阴被灼，脉络瘀阻，蕴毒成脓，而成疮疖痈疽，为其并发症的主要病机（E错）。